某男，公司老总，BMI为30，右脚趾关节间断性红肿疼痛，饮酒后加重，其应禁用的食物是
A. 燕麦
B. 鱼汤
C. 芹菜
D. 水果
E. 土豆

正确答案：B。鱼汤

解析：本题考查该男士应禁用的食物。本题中该男士BMI为30，属于肥胖；右脚趾关节间断性红肿疼痛，饮酒后加重，可知其患有痛风，应禁用高嘌呤食物，如鱼汤（B对ACDE错）。